参与钾代谢过程的放射性物质是
A. ¹³¹碘
B. ⁹⁰锶
C. ¹³⁷铯
D. ²²⁶镭
E. ²¹⁰钋

正确答案：C。¹³⁷铯

解析：本题考查参与钾代谢过程的放射性物质。¹³⁷Cs（C对ABDE错）化学性质与钾相似，易被机体充分吸收并可参与钾的代谢过程。